长期应用β受体阻断剂，如需停药，应逐步停药，整个过程至少需要
A. 1天
B. 3天
C. 5天
D. 7天
E. 14天

正确答案：E。14天

解析：本题考查β受体阻断剂的使用。长期应用β受体阻断剂，如需停药，应逐步停药，整个过程至少需要14天（E对）。β受体阻断剂突然停药可致反跳现象，应逐渐撤药，整个过程至少2周，每间隔2～3天剂量减半，停药前最后的剂量至少给14天。